正确的是
A. 牙质外面均覆有釉质
B. 牙根部外面才覆有釉质
C. 牙冠的牙质外面覆有釉质
D. 牙的中央有腔，称牙髓
E. 牙包括牙质、牙龈、牙髓和牙釉质四种成分

正确答案：C。牙冠的牙质外面覆有釉质

解析：牙质和牙根外覆有牙骨质(AB错)，牙冠外覆有釉质(C对)，牙中央的腔称为牙腔，里面容纳牙髓(D错)，牙包括牙质、牙骨质、牙髓和牙釉质四种，不含牙龈(E错)。